男性，10岁，诊断为肾病综合征，使用足量泼尼松治疗3周，复查尿蛋白（++～+++），目前首选的治疗方法是
A. 加用环磷酰胺治疗
B. 甲泼尼龙冲击治疗
C. 继续足量泼尼松治疗
D. 增加泼尼松剂量继续口服
E. 减少泼尼松剂量继续口服

正确答案：C。继续足量泼尼松治疗

解析：该患者男性，10岁，诊断为肾病综合征，使用足量泼尼松治疗3周，复查尿蛋白（++～+++），起始足量的泼尼松口服8周，必要时可延长至12周，故目前应首选继续足量泼尼松治疗的治疗方法（C对）。